水肿湿毒浸淫的治法是
A. 健脾化湿，通阳利水
B. 宣肺解毒，利尿消肿
C. 温蕴脾阳，以利水湿
D. 分利湿热
E. 疏风清热，宣肺行水

正确答案：B。宣肺解毒，利尿消肿

解析：湿毒浸淫主要治疗方法是应用麻黄连翘赤小豆汤合五味消毒饮宣肺解毒，利湿消肿（B对）。水湿浸渍证症状：全身水肿，按之没指，小便短少，身体困重，胸闷，纳呆，泛恶，腹胀，苔白腻，脉沉缓，起病缓慢，病程较长。治法：健脾化湿，通阳利水（A错）。温蕴脾阳，以利水湿主治脾肾阳虚证见水肿日久，腰以下为甚，按之凹陷不易恢复，脘腹胀闷，纳呆便溏，面色萎黄，神疲乏力，四肢倦息，小便短少，舌质淡，苔白腻或白滑，脉沉缓或沉弱（C错）。分利湿热治疗湿热壅盛证见遍体浮肿，皮肤绷紧光亮，胸脘痞闷，烦热口渴，小便短赤，或大便干结，舌红，苔黄腻，脉沉数或濡数（D错）。散风解表，宜肺行水治疗水肿的风水泛滥证：眼睑浮肿，继则四肢全身皆肿，来势迅速，多有恶风发热，肢节酸楚，小便不利等症。偏于风热者，伴咽喉红肿疼痛，舌质红，脉浮滑数。偏于风寒者，兼恶寒，咳喘，舌苔薄白，脉浮滑或浮紧（E错）。